关于心脏外形的描述，下列哪项不正确
A. 心尖由左心室构成
B. 心底大部分由左心房、小部分由右心房构成
C. 左、右心耳为左、右心房前方的突出部
D. 前后室间沟是左、右心室的表面分界
E. 心表面近心底处，有一完整环形的冠状沟

正确答案：E。心表面近心底处，有一完整环形的冠状沟

解析：心尖由左心室构成（A对）。心底大部分由左心房、小部分由右心房构成（B对）。心表面近心底处，有一近似环形（E错，为本题正确答案）的冠状沟。